细菌的遗传物质不包括
A. 染色体
B. 质粒
C. 转位因子
D. 整合子
E. 鞭毛

正确答案：E。鞭毛